关于维A酸软膏治疗痤疮的说法，错误的是
A. 有明确的致畸性，妊娠期妇女禁用
B. 为了加强疗效，可以一日多次给药
C. 使用初期可能出现皮肤干燥或脱屑，对紫外光敏感性增强，宜在睡前使用
D. 不宜用于皮肤皱褶部位
E. 湿疹类皮肤病患者不宜使用

正确答案：B。为了加强疗效，可以一日多次给药

解析：本题考查维A酸软膏的使用。维A酸治疗寻常痤疮时每晚1次，不能可以一日多次给药（B错，为本题正确答案）。维A酸软膏的使用：（1）妊娠期妇女禁用维A酸，哺乳期间应停药。本药有致畸性（A对），育龄妇女至少在用药前一个月、用药期间及治疗终止后一个月确保避孕。（2）维A酸治疗寻常痤疮时每晚1次，治疗鱼鳞病、银屑病等角化异常性皮肤病一日用量不应超过20g。（3）使用初期可能出现皮肤干燥或脱屑，对紫外光敏感性增强，宜在睡前使用（C对）。（4）维A酸与噻唑类、四环素类、喹诺酮类、吩噻嗪类、磺胺类等光敏感药物共用可增加光敏感危险。与过氧苯甲酰同时、同部位外用有配伍禁忌。若需合用，可早晚交替使用。（5）不宜用于皮肤皱褶部位（D对）。（6）湿疹、晒伤、急性和亚急性皮炎、酒渣鼻患者不宜使用（E对）。